下述不是鼠疫耶尔森菌特点的是
A. 两端浓染革兰阴性短杆菌
B. 不能在人工培养基上生长
C. 致病物质主要是鼠疫毒素
D. 以鼠蚤为媒介由鼠传染给人
E. 临床类型分腺鼠疫，败血症鼠疫和肺鼠疫等

正确答案：B。不能在人工培养基上生长